重度萎缩性胃体胃炎患者表现为
A. 胃酸明显减少
B. 胃酸明显增高
C. 胃酸轻度升高
D. 胃酸轻度减少
E. 胃酸正常或减少

正确答案：A。胃酸明显减少

解析：重度萎缩性胃体胃炎为A型胃炎，患者腺体破坏、数量减少，胃酸分泌明显受到抑制，表现为胃酸明显减小（A对）。胃酸明显增高（B错）见于胃泌素瘤，胃泌素瘤分泌大量胃泌素可刺激壁细胞增生，分泌大量胃酸。胃酸轻度升高（C错）见于十二指肠溃疡。胃酸正常或减少（E错）可见于胃溃疡、萎缩性胃窦胃炎（B型胃炎）。